疱疹性龈口炎多见于
A. 6个月～3岁婴幼儿
B. 学龄前儿童
C. 青少年
D. 中年人
E. 老年人

正确答案：A。6个月～3岁婴幼儿

解析：本题考查疱疹性龈口炎的易患人群。原发性疱疹性龈口炎以6岁以下儿童较多见，尤其是6个月至3岁婴幼儿（A对）更多，因为多数婴儿出生后，即有对抗单纯疱疹病毒的抗体，这是一种来自母体的被动免疫，4～6个月时即行消失，2岁前不会出现明显的抗体效价。学龄前儿童（B错）中发生疱疹性龈口炎的也较多，但是6个月至2岁更多。青少年（C错）发生疱疹性龈口炎的情况较少。中年人（D错）和老年人（E错）发生的疱疹性龈口炎多为复发性疱疹性龈口炎，在原发性疱疹性龈口炎感染愈合后，不管其病损程度如何，有30%～50%的病例可发生复发性疱疹性龈口炎，所以，发生复发性疱疹性龈口炎的几率是小于发生原发性疱疹性龈口炎的几率的，故疱疹炎多见于6个月～3岁婴幼儿。